桂枝合剂源于张仲景的桂枝汤方。关于桂枝合剂的说法，错误的是
A. 用于风寒感冒，症见头痛发热、鼻塞、干呕
B. 服药期间忌食生冷、油腻之物
C. 表实无汗者需覆被保暖以令汗出
D. 服药后多饮热开水或热粥
E. 病内热口渴者慎用

正确答案：C。表实无汗者需覆被保暖以令汗出

解析：本题考查的是桂枝合剂的主治和注意事项。表实无汗者慎用桂枝合剂（C错，为本题正确答案）。桂枝合剂：【功能】解肌发表，调和营卫。【主治】感冒风寒表虚证，症见头痛发热、汗出恶风、鼻塞干呕（A对）。【注意事项】表实无汗或温病内热口渴者慎用（E对）。服药期间，忌食生冷、油腻之物（B对）。服药后多饮热开水或热粥（D对），覆被保暖，取微汗为度。